一般来说，一个基本的统计表其标题、标目和线条的数量为
A. 1、2、3
B. 1、3、2
C. 2、1、3
D. 3、1、2
E. 3、2、1

正确答案：A。1、2、3